13岁女孩右下腹包块3个月，肛诊子宫右侧触及12cm×10cm×8cm囊性肿物，光滑，活动佳，腹部平片右下腹有3个大小不等钙化点，其诊断是
A. 无性细胞瘤
B. 良性囊性畸胎瘤
C. 内胚窦瘤
D. 胀大的膀胱
E. 颗粒细胞瘤

正确答案：B。良性囊性畸胎瘤

解析：卵巢肿瘤如无性细胞瘤、良性囊性畸胎瘤、内胚窦瘤、颗粒细胞瘤中，呈囊性的只有良性囊性畸胎瘤。患者肛诊子宫右侧触及12cm×10cm×8cm囊性肿物，光滑，活动佳，腹部平片右下腹有3个大小不等钙化点。可考虑诊断为良性囊性畸胎瘤（ B对）。无性细胞瘤（A错）质实，表面结节状。内胚窦瘤（C错）结节分叶状，边界不清，呈实体状。胀大的膀胱（D错）腹部平片不会出现右下腹钙化点。颗粒细胞瘤（E错）呈囊实性。